出血性与缺血性脑血管疾病的鉴别，除临床表现外，最有诊断意义的辅助检查是
A. 血常规
B. 头颅CT
C. 腰穿
D. 经颅多谱勒超声
E. 脑电图

正确答案：B。头颅CT

解析：临床上脑梗死主要应与脑出血进行鉴别，脑出血起病更急，常有头痛、呕吐、打哈欠等颅内压增高症及不同程度的意识障碍，血压增高明显，典型者不难鉴别，但大面积梗死与脑出血或轻型脑出血与一般脑梗死临床症状相似，鉴别困难，CT可以发现早期出血灶和液化的的梗死灶，从而进行鉴别，所以头颅CT（B对）是出血性与缺血性脑血管疾病鉴别最有诊断意义的辅助检查。血常规（A错）、腰穿（C错）、经颅多普勒超声（D错）、脑电图（E错）均不是鉴别出血性和缺血性脑血管疾病的最有诊断意义的辅助检查。